得神的面色特征是
A. 面色荣润，含蓄不露
B. 面色少华，暗淡不荣
C. 面色无华，晦暗暴露
D. 面似有华，泛红如妆
E. 面色无华，青如草籽

正确答案：A。面色荣润，含蓄不露

解析：本题主要考察神的分类及判断。得神通常变现为两目灵活，明亮有神，面色荣润，含蓄不露（A对），神志清晰， 表情自然，肌肉不削，反应灵敏。提示精气充盛，体健神旺，为健康表现，或虽病而精气未衰，病轻易治，预后良好。两目晦滞，目光乏神，面色少华，暗淡不荣（B错），精神不 振，思维迟钝，少气懒言，肌肉松软，动作迟缓是少神的临床表现。两目晦暗，目无光彩，面色无华，晦暗暴露（C错），精神萎 靡，意识模糊，反应迟钝，手撒尿遗，骨枯肉脱，形体羸痩是精亏神衰而失神的临床表现。面似有华，泛红如妆（D错）是假神的临床表现。面色无华，青如草籽是恶色，说明病变深重，脏腑精气已衰，其病难治，预后较差（E错）。